某医生对阳光小学的180名学生进行了口腔检查。检查结果显示，36名学生患有龋齿。其中，有6个牙龋的只有1人，有4个牙龋的为5人，有3个牙龋的为5人，有2个牙龋为10人，其余同学都只有1个牙龋。请计算龋均
A. 0.4
B. 0.2
C. 2
D. 4
E. 以上都不正确

正确答案：A。0.4